关于药物在体内分布影响因素的说法，错误的是
A. 通常脂溶性药物容易通过血-脑屏障迅速向脑脊髓转运
B. 随着胎儿的长大，血-胎屏障对药物的通透性降低
C. 药物蓄积在脂肪组织可起到贮存作用而延长药物的作用时间
D. 药物的选择性分布取决于生物膜的转运特性和药物与组织的亲和力
E. 合并用药时，药物与血浆蛋白的竞争结合可导致药物分布的改变

正确答案：B。随着胎儿的长大，血-胎屏障对药物的通透性降低

解析：本题考查的是药物在体内分布的过程。随着胎儿的长大，药物的通透性增加（B错，为本题正确答案）。药物的分布系指药物吸收后，由循环系统运送至体内各脏器组织的过程。影响药物分布的因素主要有以下方面。（1）药物与血浆蛋白结合的能力：血液中的药物可分为血浆蛋白结合型与游离型两种，与血浆蛋白结合的药物不能透过血管壁，游离型药物则能自由向组织器官转运。药物与血浆蛋白结合是一可逆过程，具有饱和现象，血浆中药物的游离型与结合型保持动态平衡，使血浆及作用部位在一定时间内保持一定的血药浓度。因此，药物与血浆蛋白结合的能力可影响其分布；合并用药时，药物与血浆蛋白竞争结合可导致药物分布的改变（E对），影响药物的作用强度和作用时间，甚至出现用药安全性问题。（2）血液循环和血管透过性：通常药物的分布是通过血液循环进行的。药物分布主要取决于组织器官血流量，其次是毛细血管通透性。血流量大，血管通透性好的组织器官，则药物分布速度快。（3）药物与组织的亲和力：药物的选择性分布主要取决于生物膜的转运特性，其次是药物与不同组织的亲和力的不同（D对）。若药物进入组织器官的速度大于从组织器官脱离返回血液循环的速度，连续给药时，药物将发生蓄积。药物若蓄积在靶组织或靶器官，则可达到满意的疗效；若蓄积在脂肪等组织，则起贮存作用，可延长药物的作用时间（C对）；若蓄积的药物毒性较大，则可对机体造成伤害。④血-脑屏障与血-胎屏障：脑和脊髓毛细管的内皮细胞连接致密，且被一层富有脑磷脂的神经细胞包被，形成脂质屏障，对于被动扩散的外来物质具有高度的选择性，这种脑组织对于外来物质有选择地摄取的能力称为血-脑屏障。通常水溶性药物很难透入脑脊髓，而脂溶性药物却能迅速向脑脊髓转运（A对）。病理状态，如脑脊髓炎症时，血-脑屏障通透性增加。在母体循环与胎儿体循环之间存在着血-胎屏障。血-胎屏障的作用过程与血-脑屏障类似。多数药物靠被动转运通过胎盘。随着胎儿的长大，药物的通透性增加；孕妇严重感染、中毒或其他疾病时，胎盘屏障作用降低。